参与DNA复制的物质不包括
A. DNA聚合酶
B. 解链酶、拓扑酶
C. 模板、引物
D. 光修复酶
E. 单链DNA结合蛋白

正确答案：D。光修复酶